下列哪个指标是用于测定发病率不准确且病死率极低的传染病的流行强度的
A. 病死率
B. 现患率
C. 超额死亡率
D. 累积死亡率
E. 以上都不是

正确答案：C。超额死亡率

解析：本题考查超额死亡率的应用。超额死亡率（C对ABDE错）是指由于流感流行所造成的超过预期的死亡率，即超过相近的几个非流行年同期的平均死亡率的部分。其主要用于描述发病率很不准确，病死率极低的传染病的流行强度。研究超额死亡率有助于了解疾病流行的严重程度、时间变化规律及其在不同人群和地区的流行特征。